下列哪项不属于病例对照研究的特点
A. 相对经济
B. 根据所得结果可以计算OR值
C. 选择无病者作为对照
D. 对暴露因素的估计可能存在偏性
E. 可计算两组的发病率

正确答案：E。可计算两组的发病率